阴寒凝滞之胸痹，胸痛彻背，身寒痛甚，四肢厥冷。治疗应首选
A. 通脉四逆汤
B. 黄芪桂枝五物汤
C. 栝蒌薤白白酒汤
D. 金匮肾气丸
E. 栝蒌薤白半夏汤

正确答案：C。栝蒌薤白白酒汤

解析：阴寒凝滞之胸痹，诸阳受气于胸中而转行于背，寒邪内侵，致使阳气不运，气机阻痹，故见胸痛彻背，身寒痛甚；阳气不足，故见四肢厥冷。治宜辛温通阳、开痹散寒，方选栝蒌薤白白酒汤（C对）。通脉四逆汤功能温通肾阳，为治疗腹痛之寒邪内阻证选方（A错）。黄芪桂枝五物汤功能益气温经，和血通痹，为治疗血痹的选方（B错）。金匮肾气丸功能滋阴温阳，补肾固涩，为治疗消渴之下消证的选方（D错）。栝蒌薤白半夏汤功能温通豁痰，为治疗胸痹之痰浊痹阻证选方（E错）。